患者，女，50岁。多年来反复出现尿频、尿痛，腰膝酸软，少腹坠胀，神疲乏力，舌淡红苔薄白，脉沉细。检查：双肾区叩击痛，尿白细胞10～20个/高倍视野，白细胞管型1～4个/高倍视野。治疗应首选
A. 四君子汤
B. 补中益气汤
C. 当归补血汤
D. 温经汤
E. 春泽汤

正确答案：B。补中益气汤

解析：患者多年来反复出现尿频、尿痛，病为淋证。久病体虚或劳伤过度，以致脾肾亏虚，湿浊留恋不去，故见腰膝酸软，少腹坠胀，神疲乏力；舌淡红苔薄白，脉沉细为脾肾亏虚，湿热屡犯证之侯。检查发现双肾区叩击痛，尿白细胞增多，可见白细胞管型。可诊断为尿路感染脾肾亏虚，湿热屡犯证，治法为健脾补肾，可用补中益气汤（B对）加减。四君子汤（A错）可益气健脾，治疗脾胃气虚证。当归补血汤（C错）可以益气补血，治疗血虚发热证。温经汤（D错）可以温经散寒，养血祛瘀，治疗冲任虚寒、瘀血阻滞证。春泽汤（E错）可以升清降浊，化气利水，治疗气虚水停证。